《中国药典》收载的生脉饮为口服液，其处方由红参、麦冬和五味子组成。具有益气复脉、养阴生津之功效。处方中红参的产地加工方法为
A. 发酵法
B. 煮法
C. 蜜炙法
D. 蒸法
E. 复制法

正确答案：D。蒸法

解析：本题考查的是常用的产地加工方法。处方中红参的产地加工方法为蒸法（D对）。常用的产地加工方法。1.拣、洗：将采收的新鲜药材除去泥沙杂质和非药用部分。但具芳香气味的药材一般不用水洗，如薄荷、细辛、木香等。鲜用药材洗后晾干，进行保鲜处理。2.切片：较大的根及根茎类、坚硬的藤木类和肉质的果实类药材有的趁鲜切成块、片，以利干燥。如大黄、鸡血藤、木瓜。但对具挥发性成分和有效成分易氧化的则不宜切成薄片干燥，如当归、川芎等。3.蒸、煮（B错）、烫：含浆汁、淀粉或糖分多的药材，用一般方法不易干燥，需先经蒸、煮或烫的处理，则易干燥，同时使一些药材中的酶失去活力，不致分解药材的有效成分。但加热时间的长短不等，视药材的性质而定，如天麻、红参蒸至透心，白芍煮至透心，太子参置沸水中略烫。有些动物药，如桑螵蛸、五倍子蒸至杀死虫卵或蚜虫。4.搓揉：有些药材在干燥过程中皮、肉易分离而使药材质地松泡，在干燥过程中要时时搓揉，使皮、肉紧贴，达到油润、饱满、柔软或半透明等目的。如玉竹等。5.发汗：有些药材在加工过程中为了促使变色，增强气味或减小刺激性，有利于干燥，常将药材堆积放置，使其发热、“回潮”，内部水分向外挥散，这种方法称为“发汗”，如厚朴、杜仲、玄参、续断、茯苓等。6.干燥：除少数药材，如石斛、鱼腥草、地黄、益母草等，有时要求鲜用外，大多数药材经加工后均应及时干燥。干燥的目的是除去新鲜药材中的大量水分，避免发霉、变色、虫蛀以及有效成分的分解和破坏，保证药材质量，利于贮藏。发酵法（A错）、蜜炙法（C错）与复制法（E错）为饮片的炮制方法。发酵法属于中药特殊的炮制方法之一，指经净制或处理后的药物，在一定的温度和湿度条件下，利用霉菌和酶的催化分解作用，使药物发泡、生衣的方法。蜜炙法是将净选或切制后的药物，加入定量熟蜜拌炒的方法。复制法是将净选后的药物加入一种或数种辅料，按规定操作程序，反复炮制的方法。